关于IgA下述哪项是错误的
A. 是外分泌液中主要的抗体
B. 血清型IgA主要存在于血清中
C. IgA占血清免疫球蛋白总量30%以上
D. 新生儿易患呼吸与其IgA合成不足有关
E. 婴儿可从母亲初乳中获得SIgA

正确答案：C。IgA占血清免疫球蛋白总量30%以上

解析：IgA的特性和功能：IgA占血清免疫球蛋白总量的10%～15%，是外分泌液中主要的抗体。IgA有血清型IgA和分泌型IgA两类。血清型IgA为单体，主要存在于血清中：分泌型IgA（SIgA），为二聚体，由J链连接，结合有分泌片，主要存在于胃肠道和支气管分泌液、初乳、唾液和泪液中，通过与相应病原微生物结合，阻止病原体黏附到细胞表面，发挥局部抗感染作用。婴儿出生后4～6个月开始合成IgA。新生儿易患呼吸、胃肠道感染与其IgA合成不足有关。婴儿可从母亲初乳中获得SIgA，以抵抗呼吸道和消化道的病原体。掌握“各类球蛋白的特性和功能”知识点。